发挥体温调定点作用的中枢部位在
A. 脑干网状结构
B. 下丘脑弓状核
C. 丘脑特异感觉接替核
D. 视前区-下丘脑前部
E. 延髓下部薄、楔束核

正确答案：D。视前区-下丘脑前部